患者，女，26岁，诊断为艾滋病。该病Ⅰ期的临床表现应该是
A. 发热、全身不适、头痛、厌食、恶心、肌痛、关节痛和淋巴结肿大，持续1～3周后缓解
B. 临床上没有任何症状，但血清中能检出HIV以及HIV核心蛋白和包膜蛋白的抗体，具有传染性
C. 除腹股沟淋巴结以外，全身其他部位两处或两处以上淋巴结肿大，一般持续3个月以上
D. 出现头痛、癫痫、进行性痴呆、下肢瘫痪
E. 卡波西肉瘤、慢性淋巴性间质性肺炎等

正确答案：A。发热、全身不适、头痛、厌食、恶心、肌痛、关节痛和淋巴结肿大，持续1～3周后缓解

解析：艾滋病Ⅰ期为HIV感染进入人体内24～38小时，临床表现以发热最为常见，可伴有全身不适、头痛、盗汗、恶心、呕吐、腹泻、咽痛、皮疹、肌肉痛、关节痛、淋巴结肿大，持续1～3周后可自行缓解（A对）；故临床上没有任何症状，但血清中能检出HIV以及HIV核心蛋白和包膜蛋白的抗体，具有传染性（B错）是错误的；Ⅱ期表现为除腹股沟外全身其他部位两处或两处以上淋巴结肿大（C错）；不会出现头痛、癫痫、进行性痴呆、下肢瘫痪（D错）；卡波西肉瘤、慢性淋巴性间质性肺炎等（E错）出现在第Ⅲ期。